瞿麦的功效是
A. 清心除烦
B. 祛风止痒
C. 破血通经
D. 清肝明目
E. 清热排脓

正确答案：C。破血通经

解析：本题考查瞿麦的功效。瞿麦的功效是破血通经（C对）。瞿麦【功效】利尿通淋，破血通经。灯心草【功效】利尿通淋，清心除烦（A错）。地肤子【功效】利尿通淋，祛风止痒（B错）。秦皮【功效】清热解毒，燥湿止带，清肝明目（D错）。薏苡仁【功效】利水渗湿，健脾止泻，除痹，清热排脓（E错）。